创伤性溃疡治疗常用含漱液为
A. 1%甲紫
B. 碘伏溶液
C. 3%双氧水
D. 5%双氧水
E. 普鲁卡因液

正确答案：E。普鲁卡因液

解析：创伤性溃疡用消炎止痛药防止感染和止痛：1%甲紫、2.5%金霉素甘油，各种抗生素药膜等局部涂或贴敷。含漱剂：达克罗宁液、普鲁卡因液。中药粉外敷：养阴生肌散、锡类散等。掌握“创伤性溃疡”知识点。